女，22岁。在与恋人的一次激烈争吵之后，倍感气愤、烦闷，次晨出现双下肢瘫痪、无法起立行走的症状，经查无神经系统器质性病变的临床依据。如欲对该患者实施尝试性心理治疗，首选的方法为
A. 暗示疗法
B. 认知疗法
C. 自由联想
D. 支持疗法
E. 放松训练

正确答案：A。暗示疗法

解析：青年女性，因情绪原因出现双下肢瘫痪等症状，经查无器质性病变的临床依据，因此考虑为心理性疾病。在疾病的治疗中，可以采用暗示疗法，治疗师有意识的使用暗示疗法（A对）达到消除或减轻双下肢瘫痪的问题。认知疗法（B错）重点在于纠正患者歪曲的思维，使其通过正确的认知达到接纳自己，积极参与等目的。自由联想（C错）旨在宣泄病人潜意识的冲突，以舒缓焦虑，找到现实中解决问题的方法。以上二者均与题不符。放松训练（E错）关键方法在于肌肉等紧张-松弛的循环周期的把控，患者双下肢瘫痪，无法配合进行。